突发环境污染事件的预警系统分为4个级别，Ⅰ级的颜色为
A. 蓝色
B. 黄色
C. 橙色
D. 红色
E. 黑色

正确答案：D。红色